2016年《中国居民膳食指南》建议，成人每日反式脂肪酸摄入量不超过
A. 1.0g
B. 2.0g
C. 2.5g
D. 5g
E. 10g

正确答案：B。2.0g

解析：本题考查2016年《中国居民膳食指南》建议的成人每日反式脂肪酸摄入量。根据《中国居民膳食指南（2016）》，成人每日反式脂肪酸摄入量应不超过2.0g（B对ACDE错）。